耳环石斛的原植物是
A. 金釵石斛
B. 马鞭石斛
C. 环草石斛
D. 黄草石斛
E. 铁皮石斛

正确答案：E。铁皮石斛

解析：本题考查的是铁皮石斛的名称。耳环石斛的原植物是铁皮石斛（E对）。铁皮石斛【采收加工】11月至翌年3月采收，除去杂质，剪去部分须根，边加热边扭成螺旋形或弹簧状，烘干；或切成段，干燥或低温烘干。前者习称“铁皮枫斗（耳环石斛）”，后者习称“铁皮石斛”。石斛【来源】为兰科植物金钗石斛（A错）、霍山石斛、鼓槌石斛或流苏石斛的栽培品及其同属植物近似种的新鲜或干燥茎。